结核病的短程督导化疗是指
A. 医师每次只给患者开1个月的抗结核药物，并叮嘱其按时按量服用
B. 医师每次只给患者开10天的抗结核药物，并叮嘱其按时按量服用
C. 医师每次只给患者开1周的抗结核药物，并叮嘱其按时按量服用
D. 医师每次只给患者开两天的抗结核药物，并叮嘱其按时按量服用
E. 医师督促患者服用每剂抗结核药物

正确答案：E。医师督促患者服用每剂抗结核药物